性格指的是
A. 个体对客观现实所持的稳定态度
B. 习惯了的行为方式
C. 个体对客观现实所持的稳定态度以及习惯了的行为方式
D. 做什么
E. 怎样做

正确答案：C。个体对客观现实所持的稳定态度以及习惯了的行为方式